根据《药品说明书和标签管理规定》，关于药品说明书规定的说法，错误的是
A. 非处方药应列出主要辅料名称
B. 注射剂应列出全部辅料名称
C. 化学药列出全部活性成份
D. 中成药组方中应列出全部中药药味
E. 药品说明书核准日期和修改日期应当在说明书中醒目标示

正确答案：A。非处方药应列出主要辅料名称

解析：本题考查药品说明书的书写要求。根据《药品说明书和标签管理规定》，非处方药说明书中应列出全部辅料名称（A错，为本题正确答案）。【成分】：（1）化学药品和治疗用生物制品说明书：①列出活性成分的化学名称、化学结构式、分子式、分子量（C对）。②复方制剂可以不列出每个活性成分化学名称、化学结构式、分子式、分子量内容。本项可以表达为“本品为复方制剂，其组分为：×××”。组分按一个制剂单位（如每片、粒、支、瓶等）分别列出所含的全部活性成分及其量。③多组分或者化学结构尚不明确的化学药品或者治疗用生物制品，应当列出主要成分名称，简述活性成分来源。④处方中含有可能引起严重不良反应的辅料的，该项下应当列出该辅料名称。⑤注射剂应当列出全部辅料名称（B对）。（2）预防用生物制品说明书：包括该制品的主要成分（如生产用毒株或基因表达提取物等）和辅料、生产用细胞、简述制备工艺、成品剂型和外观等。冻干制品还应增加冻干保护剂的主要成分。（3）中药、天然药物处方药说明书：应列出处方中所有的药味或有效部位、有效成分等（D对）。注射剂还应列出所用的全部辅料名称；处方中含有可能引起严重不良反应的辅料的，在该项下也应列出该辅料名称。成分排序应与国家批准的该品种药品标准一致，辅料列于成分之后。对于处方已列入国家秘密技术项目的品种，以及获得中药一级保护的品种，可不列此项。（4）化学药品非处方药说明书：处方组成及各成分含量应与该药品注册批准证明文件一致。成分含量按每一个制剂单位（如每片、粒、包、支、瓶等）计。单一成分的制剂须写明成分通用名称及含量，并注明所有辅料成分。表达为“本品每×含××××××。辅料为：××××××”。复方制剂须写明全部活性成分组成及各成分含量，并注明所有辅料成分。表达为“本品为复方制剂，每×含×××××××。辅料为：×××××××”。（5）中成药非处方药说明书：除《中药品种保护条例》规定的情形外，必须列出全部处方组成和辅料，处方所含成分及药味排序应与药品标准一致。处方中所列药味其本身为多种药材制成的饮片，且该饮片为国家药品标准收载的，只需写出该饮片名称。药品说明书中的“核准和修改日期”（E对）：核准日期为国家药品监督管理部门批准该药品注册的时间。修改日期为此后历次修改的时间。核准和修改日期应当印制在说明书首页左上角。修改日期位于核准日期下方，按时间顺序逐行书写。